天王补心丹中敛心气而安神的药物是
A. 丹参、五味子
B. 茯苓、五味子
C. 远志、五味子
D. 人参、五味子
E. 酸枣仁、五味子

正确答案：E。酸枣仁、五味子

解析：本题考查天王补心丹的方解，属于理解记忆内容。五味子之酸以敛心气，安心神，符合题目要求，所以五味子正确。酸枣仁、柏子仁养心安神，酸枣仁之酸也可以敛心气（E对）。茯苓、远志养心安神，所以茯苓与远志在天王补心丹中发挥的作用相同，可以排除（BC错）。丹参清心活血，和补血药使补而不滞，则心血易生（A错）。人参补气以生血，并能安神益智（D错）。